女性，38岁，糖尿病12年，每日皮下注射人混合胰岛素治疗，早餐前30单位，晚餐前24单位，每日进餐规律，主食量300g。近来空腹血糖12.5mmol/L，餐后血糖7.6～9.0mmol/L。为确定空腹高血糖的原因最有意义的检查是
A. 多次测定空腹血糖
B. 多次测定餐后血糖
C. 测定糖化血红蛋白
D. 夜间血糖监测
E. 口服葡萄糖耐量试验

正确答案：D。夜间血糖监测

解析：患者规律使用胰岛素替代治疗与饮食治疗后出现空腹高血糖，餐后血糖控制尚可，可能的原因为“黎明现象”或Somogyi效应，应予夜间多次血糖测定以鉴别空腹高血糖的原因（D对）。多次空腹血糖（A错）、多次餐后血糖（B错）用于血糖的日常监测，对明确空腹血糖升高的原因没有价值。糖化血红蛋白（C错）主要用于反映近2～3个月来血糖的控制情况。口服葡萄糖耐量试验（E错）主要用于确诊糖尿病。